2721-2015）规定，食用盐中氯化钠含量（g/100g）应≥
A. 0.8
B. 0.85
C. 0.9
D. 0.95
E. 0.97

正确答案：E。0.97

解析：本题考查我国《食品安全国家标准食用盐》（GB 2721-2015）规定的食用盐中氯化钠含量。我国《食品安全国家标准 食用盐》（GB 2721-2015）规定，食用盐中氯化钠含量（g/100g）应≥97%（以干基计）（E对ABCD错）。